室内小气候主要包括
A. 气温、气湿、气流、热辐射
B. 气温、气湿、气流、气压
C. 气温、气湿、气压、热辐射
D. 气温、气湿、热辐射、空气离子
E. 气温、气湿、气流、空气离子

正确答案：A。气温、气湿、气流、热辐射

解析：本题考查室内小气候的组成因素。住宅的室内由于屋顶、地板、门窗和墙壁等围护结构以及室内的人工空气调节设备等综合作用，形成了与室外不同的室内气候，称为室内小气候，主要包括气温、气湿、气流和热辐射（A对BCDE错）。